刘某，男，34岁。热病后突然出现肢体软弱无力，皮肤枯燥，心烦口渴，咳呛少痰，咽干不利，小便黄少，大便干燥，舌质红，苔黄，脉细数。其中医治法是
A. 清热利湿，通利筋脉
B. 清热润燥，养肺生津
C. 补脾益气，健运升清
D. 补益肝肾，滋阴清热
E. 清热润燥，补益肝肾

正确答案：B。清热润燥，养肺生津

解析：本病例以肢体软弱无力为主，故诊断为痿证；温热之邪犯肺，肺脏气阴受伤，津液不足以敷布全身，遂致筋脉皮肤失养而肢体痿软，皮肤枯燥。热邪伤津，故心烦口渴、小便黄少、大便干燥。肺津不能上润肺系，故咽干不利、咳呛少痰。舌质红、苔黄、脉细数，均为阴伤津涸，虚热内炽之象，故其证候为肺热津伤证，治以清热润肺，濡养筋脉（B对）。清热利湿，通利筋脉是痿证湿热浸淫证的治疗原则（A错）。补脾益气，健运升清是痿证脾胃亏虚证的治则（C错）。补益肝肾，滋阴清热是痿证肝肾亏损证的治疗原则（D错）。